小儿机体发育所遵循的规律，正确的是
A. 是一个连续平均的过程
B. 年龄越大发育越快
C. 婴儿期发育最快
D. 各系统发育快慢一致
E. 体格上的个体差异随年龄增长而逐渐减小

正确答案：C。婴儿期发育最快

解析：生长发育是一连续的、有阶段性的过程；各系统、器官的生长发育不平衡；生长发育的个体差异；生长发育一般遵循的一般规律：由上到下、由近到远、由粗到细、由低级到高级、由简单到复杂的规律。生长发育在整个小儿时期不断进行，是一个连续不断的过程，但其发育速度又因年龄而异。如体格方面，婴儿期是第一个生长高峰，以后速度减慢，青春期又出现第二个生长高峰。掌握“小儿生长发育规律”知识点。